β-内酰胺类抗生素的作用机制是
A. β-内酰胺酶抑制剂，阻止细胞壁的形成
B. 与PABA竞争，干扰细菌正常生长，属二氢叶酸合成酶抑制剂
C. 与PABA竞争，干扰细菌正常生长，属二氢叶酸还原酶抑制剂
D. D-丙氨酸多肽转移酶抑制剂，阻止细胞壁的形成
E. 环氧酶抑制剂，干扰细胞生长

正确答案：D。D-丙氨酸多肽转移酶抑制剂，阻止细胞壁的形成

解析：本题考查β-内酰胺类抗生素的作用机制。β-内酰胺类抗生素能够竞争性地与酶活性位点共价结合，从而抑制PBPs，破坏细菌细胞壁的形成（D对）。PBPs是细菌细胞壁合成中不可缺少的具有催化活性的D、D-肽酶，如转肽酶、羧肽酶、肽链内切酶。